临床上一般不用作浸润麻醉的药物是
A. 普鲁卡因
B. 利多卡因
C. 布比卡因
D. 地卡因
E. 美匹卡因

正确答案：D。地卡因

解析：本题考查局麻药。临床常用局麻药按其化学结构可分为酯类和酰胺类。常用酰胺类有利多卡因、布比卡因、阿替卡因和美匹卡因（甲哌卡因）；酯类的局麻药有普鲁卡因和地卡因。其中因地卡因毒性较大，为普鲁卡因的10～20倍，一般不用作浸润麻醉（D对），由因其穿透力强，常用于表面麻醉。普鲁卡因（A错）、利多卡因（B错）、布比卡因（C错）、美匹卡因（E错）因其毒性先对较低，扩散性强均可用作浸润麻醉。